在观察和测量对象时方法不当可产生
A. 选择偏倚
B. 回忆偏倚
C. 测量偏倚
D. 失访偏倚
E. 随意误差

正确答案：C。测量偏倚

解析：本题考查测量偏倚。在观察和测量对象时方法不当可产生测量偏倚（C对ABDE错）。测量偏倚主要由于对研究对象所采用的测量和观察方法不一致所造成的系统误差。